临床给药可根据药物半衰期确定给药间隔时间和给药途径，半衰期12h的药物，通常选择
A. 2～3个半衰期给药1次
B. 每日给药1次
C. 每个半衰期给药1次
D. 静脉滴注给药
E. 每日给药3次

正确答案：C。每个半衰期给药1次

解析：本题考查根据半衰期确定给药间隔。根据半衰期确定给药间隔时，如半衰期在8～24小时，每个半衰期给药1次（C对），如果需要立即达到稳态，可首剂加倍。如半衰期小于30分钟，治疗指数低的药物一般要静脉滴注给药（D错）。如半衰期大于24小时，每天给药1次（B错）较为方便，可提高患者对医嘱的依从性。